某女生，3岁时身高开始落后，11岁时下降到正常标准的P₁₀以下；接受治疗后，身高迅猛增长，并在16岁时恢复到P₅₀左右。此女生接受的治疗是
A. 生长素
B. 甲状腺素
C. 肾上腺素
D. 胰岛素
E. 雌激素

正确答案：B。甲状腺素